颅骨软化多见于
A. 3个月以内
B. 3～6个月
C. 6个月以上
D. 7～8个月以上
E. 12个月

正确答案：B。3～6个月

解析：颅骨软化：多见于3～6个月婴儿，因此时颅骨发育最快，软化部分常发生在枕骨或顶骨中央，约6个月时颅骨软化逐渐消失。掌握“维生素D缺乏性佝偻病”知识点。